我国伤害死亡的高发人群是
A. 1岁的婴儿
B. 1～14岁儿童
C. 15～59岁劳动力人口
D. 15～34岁女性
E. 60岁及以上的老年人

正确答案：C。15～59岁劳动力人口